女，50岁。纳差5年，面色苍白、乏力半年。胃镜检查见胃体黏膜苍白、变薄、血管透见明显。最可能实验室检查结果是
A. 基础胃酸分泌增加
B. 正细胞正色素性贫血
C. 血叶酸水平增高
D. 血促胃液素水平降低
E. 血维生素B12水平降低

正确答案：E。血维生素B12水平降低

解析：中年女性患者，纳差5年（长期慢性胃病常见症状），面色苍白、乏力半年（常见贫血体征）。胃镜检查见胃体黏膜苍白、变薄、血管透见明显（慢性萎缩性胃炎表现）。结合上述病史、临床表现和实验室检查，患者最可能的诊断是慢性萎缩性胃炎合并巨幼细胞性贫血，由于胃液分泌不足导致维生素B12吸收障碍，进而导致巨幼红细胞性贫血，最可能的实验室检查结果是患者血维生素B12水平降低（E对），基础胃酸分泌降低（A错），血象为巨细胞性贫血。正细胞正色素性贫血（B错）多考虑再生障碍性贫血。血叶酸水平（C错）和血促胃液素水平（D错）可不变。